确诊消化性溃疡首选的检查方法是
A. B超
B. X线
C. 幽门螺旋杆菌检测
D. 胃镜
E. 胃液分析

正确答案：D。胃镜

解析：确诊消化性溃疡首选胃镜（D对），其普及率高，操作便捷且损伤小，对于难以诊断的消化性溃疡还可取活组织病理检查确诊。B超（A错）受气体阻碍，不用于空腔脏器疾病的确诊。X线钡餐（B错）效果逊于胃镜，用于胃镜禁忌者、不愿接受胃镜检查者和没有胃镜时。幽门螺旋杆菌可见于慢性胃炎、胃癌等多种疾病，故幽门螺旋杆菌检测（C错）不具有特异性。胃液分析（E错）可测定基础胃酸分泌量（BAO）和最大胃酸分泌量（MAO），了解溃疡病患者胃酸分泌情况，现已少用。